视觉性语言中枢
A. 额上回上、下的皮质
B. 额下回的后部
C. 颞横回
D. 角回
E. 无

正确答案：D。角回

解析：视觉性语言区在顶下小叶的角回（D对）。